精神障碍诊断、治疗的原则说法有误的是
A. 应当遵循维护患者合法权益的原则
B. 应当遵循尊重患者人格尊严的原则
C. 保障患者在现有条件下获得良好的精神卫生服务
D. 精神障碍分类、诊断标准和治疗规范，由国务院卫生行政部门组织制定
E. 精神障碍分类、诊断标准和治疗规范，由省级以上卫生行政部门组织制定

正确答案：E。精神障碍分类、诊断标准和治疗规范，由省级以上卫生行政部门组织制定